对内脏的描述，何者正确
A. 包括消化、呼吸、泌尿、生殖四大系统
B. 各系统与外界不相通
C. 大部分位于胸、腹膜腔内
D. 胸、腹膜与会阴不属内脏学范畴
E. 消化道的管壁由3层组织构成

正确答案：A。包括消化、呼吸、泌尿、生殖四大系统

解析：内脏包括消化、呼吸、泌尿、生殖四大系统(A对)，各系统通过孔道直接或间接与外界相通(B错)，大部分位于胸腔、腹腔和盆腔内(C错)，胸、腹膜与会阴因与内脏密切相关，也属于内脏学范畴(D错)，消化道的管壁由4层组织构成(E错)，呼吸、泌尿、生殖道各器官由3层组织构成。